对中药材生产全过程进行规范化管理应遵循
A. GMP
B. GAP
C. GCP
D. GLP
E. GSP

正确答案：B。GAP

解析：本题考查中药材生产质量管理规范。对中药材生产全过程进行规范化管理应遵循GAP（B对）。《中药材生产质量管理规范》（GAP）是中药材生产和质量管理的基本准则，适用于中药材生产企业生产中药材（含植物、动物药）的全过程。《药品生产质量管理规范》（GMP）（A错）是药品生产和质量管理的基本准则，适用于药品制剂生产的全过程和原料药生产中影响成品质量的关键工序。《药物临床试验质量管理规范》（GCP）（C错）适用于为申请药品注册而进行的药物临床试验。《药物非临床试验质量管理规范》（GLP）（D错）适用于为申请药品注册而进行的药物非临床安全性评价研究。《药品经营质量管理规范》（GSP）（E错）是药品经营管理和质量控制的基本准则。